患者，男性，40岁，发热伴鼻出血1周，检查牙龈肿胀，肝脾轻度肿大；血红蛋白40g/L，白细胞6.0×10⁹/L，血小板15×10⁹/L，骨髓象：原始细胞占60％，过氧化酶染色弱阳性，非特异性酯酶阳性，阳性反应可被氟化钠抑制，应诊断为
A. 急性粒细胞白血病
B. 急性早幼粒细胞白血病
C. 急性淋巴细胞白血病
D. 急性红白血病
E. 急性单核细胞白血病

正确答案：E。急性单核细胞白血病